骨折的治疗原则中，除复位、固定还有
A. 抗感染
B. 功能锻炼
C. 内外用药
D. 物理治疗
E. 止痛镇静

正确答案：B。功能锻炼

解析：骨折的治疗原则是复位、固定和康复治疗。康复治疗是在不影响固定的情况下，早期合理的功能锻炼（B对）。抗感染（A错）、内外用药（C错）、物理治疗（D错）、止痛镇静（E错）均为骨折的辅助治疗，不是骨折的治疗原则。